冷脓肿是指
A. 口底蜂窝织炎
B. 结核性淋巴结炎
C. 化脓性淋巴结炎
D. 化脓性下颌下腺炎
E. 颈部转移癌坏死

正确答案：B。结核性淋巴结炎

解析：本题考查冷脓肿。冷脓肿是指当结核性淋巴结炎（B对）波及周围组织时，淋巴结可彼此粘结可彼此粘结成团，或与皮肤粘结，但皮肤表面无红、热及明显压痛，扪之有波动感的液化现象。可穿过皮肤形成窦道，并向外排出坏死物，经久难愈。治疗以全身抗结核药物为主，也可做病灶清除术。